下列哪项不属于特殊用途的化妆品
A. 脱毛剂
B. 美乳剂
C. 润肤霜
D. 祛斑剂
E. 防晒剂

正确答案：C。润肤霜